下列偏倚可通过分层分析控制的是
A. 伯克森偏倚
B. 奈曼偏倚
C. 检出症候偏倚
D. 混杂偏倚
E. 信息偏倚

正确答案：D。混杂偏倚

解析：本题考查分层分析的作用。在流行病学研究中，可通过分层分析来处理混杂偏倚（D对ABCE错）。